有关锁骨下动脉的描述，正确的是
A. 起自主动脉弓
B. 右侧长于左侧
C. 斜过胸膜顶后方
D. 全长被前斜角肌分为三段
E. 全长均走行于锁骨下方

正确答案：D。全长被前斜角肌分为三段

解析：左锁骨下动脉起自主动脉弓，右锁骨下动脉起自头臂干（A错）。经胸膜顶的前方（C错）。全长被前斜角肌分为三段（D对）。穿斜角肌间隙至第1肋外侧缘（E错）续为腋动脉。